女性，30岁。在颈丛麻醉下施行了甲状腺腺瘤切除术，手术顺利。术后病人出现饮水呛咳症状，最可能的原因是
A. 喉返神经损伤
B. 喉上神经内支损伤
C. 喉上神经外支损伤
D. 喉头水肿
E. 气管塌陷

正确答案：B。喉上神经内支损伤

解析：喉上神经内支支配喉部粘膜，若喉上神经内支损伤（B对），则喉部粘膜感觉消失，会厌功能受损。进食特别是饮水时，会厌不能及时封闭喉口，容易误咽发生呛咳。单侧喉返神经损伤（A错）大都导致声嘶，双侧喉返神经损伤则可导致失声或严重的呼吸困难甚至窒息。喉上神经外支损伤（C错）会使环甲肌瘫痪，声带松弛、音调降低。喉头水肿（D错）、气管塌陷（E错）可引起呼吸道阻塞，导致术后呼吸困难。